初级卫生保健的工作重点应是
A. 治疗疾病
B. 预防和促进健康
C. 社区康复
D. 计划生育
E. 寻找各种致病因素

正确答案：B。预防和促进健康

解析：本题考查初级卫生保健的工作重点。初级卫生保健是指普及适宜的、技术可靠、社会能接受和负担的技术，使全体人民公平地获得基本卫生服务。其工作重点是预防疾病，增进健康（B对ACDE错），控制和消灭一切危害人民健康的各种因素。